预防医学是研究
A. 人体健康与环境的关系
B. 个体与群体的健康
C. 人群的健康
D. 社会环境与健康的关系
E. 健康和无症状患者

正确答案：A。人体健康与环境的关系

解析：预防医学以个体和确定的群体为对象，目的是保护、促进和维护健康，预防疾病、失能和早逝。强调环境与人群的相互依赖、相互作用和协调发展，研究的是各种环境因素对人群健康和疾病的作用规律（A对）。